在《中国药典》中，使用铈量法作为含量测定方法的药物是
A. 盐酸四环素
B. 地西泮
C. 硝苯地平
D. 异烟肼
E. 硫酸庆大霉素

正确答案：C。硝苯地平

解析：本题考查铈量法。在《中国药典》中，使用铈量法作为含量测定方法的药物是硝苯地平（C对）。铈量法是以四价铈离子溶液为标准溶液的氧化还原滴定方法，常用硫酸铈的硫酸溶液作滴定剂，以邻二氮菲为指示剂。盐酸四环素（A错）可使用高效液相色谱法。地西泮（B错）可使用非水碱量法。异烟肼（D错）可使用氧化还原滴定法。硫酸庆大霉素（E错）可使用微生物法。